女，65岁，乏力，胸痛1个月，既往体健，查体：轻度贫血貌，双侧肋骨有局部压痛，实验室检查：血常规：Hb80g/L,WBC5.6×10⁹/L,PIt120×I09/L，血清总蛋白100g/L，白蛋白27g/L,SCr190umol/L，骨髓细胞学检查是骨髓中幼浆细胞占0.45。为明确诊断，最重要检查是
A. 血、尿免疫固定电泳
B. 血清B2微球蛋白测定
C. 尿常规
D. 尿本周蛋白测定
E. 血沉

正确答案：A。血、尿免疫固定电泳

解析：老年患者，乏力，胸痛1个月，查体：轻度贫血貌，双侧肋骨有局部压痛（多发性骨髓瘤的主要症状），实验室检查：血常规：Hb80g/L（正常值为110～150g/L，血红蛋白减低），WBC5.6×10⁹/L（正常值为4～10×10⁹/L），Plt120×10⁹/L（正常值为100～300×10⁹/L），血清总蛋白100g/L（正常值为60～80g/L，血清总蛋白增高），白蛋白27g/L（40～55g/L，白蛋白减低）SCrl90umol/L（正常值为88.4～176.8g/L，血肌酐增高），骨髓细胞学检查是骨髓中幼浆细胞占0.45（正常情况下骨髓中没有浆细胞），根据该患者的临床症状、体征、实验室检查，更多考虑的诊断为多发性骨髓瘤（MM），实验室检查中血清中出现M蛋白是本病的突出特点，血清蛋白电泳可见一染色浓而密集、单峰突起的M蛋白，正常免疫球蛋白减少，进行M蛋白免疫分型时常常做血、尿免疫固定电泳（A对）。血清β₂-微球蛋白（B错）与全身骨髓瘤细胞总数有显著相关性。在肾功能不全时会使病人β₂-微球蛋白增高得更加显著。尿常规（C错）可出现蛋白尿、血尿和管型尿。24小时尿轻链、尿免疫固定电泳的检测。约半数病人尿中出现本周蛋白（D错）。